支配大腿内侧群肌
A. 坐骨神经
B. 闭孔神经
C. 股神经
D. 阴部神经
E. 隐神经

正确答案：B。闭孔神经

解析：坐骨神经（A错）在股后区发出肌支支配股二头肌、半腱肌和半膜肌，同时也有分支至髋关节。闭孔神经（B对）支配大腿内侧群肌。股神经（C错）主要分布于髂肌、耻骨肌、股四头肌和缝匠肌。阴部神经（D错）支分布于会阴部的肌群和皮肤以及外生殖器的皮肤。隐神经（E错）出分支分布于髌下、小腿内侧面及足内侧缘的皮肤。